取药材少量，火烧时有紫红色烟雾发生。它是
A. 青黛
B. 松花粉
C. 蒲黄
D. 没药
E. 海金沙

正确答案：A。青黛

解析：本题考查的是青黛药材的性状鉴别。取药材少量，火烧时有紫红色烟雾发生。它是青黛（A对）。青黛：【性状鉴别】药材为深蓝色的粉末，体轻，易飞扬；或呈不规则多孔性的团块、颗粒，用手搓捻即成细末。微有草腥气，味淡。取本品少量，用微火灼烧，有紫红色烟雾发生。取本品少量，滴加硝酸，产生气泡并显棕红色或黄棕色。海金沙（D错）：【性状鉴别】药材呈粉末状，棕黄色或浅棕黄色。体轻，手捻有光滑感，置手中易由指缝滑落。气微，味淡。将海金沙粉末撒在水中则浮于水面，加热始逐渐下沉；将其少量撒于火上，即发出轻微爆鸣及明亮的火焰。没药（E错）：【性状鉴别】药材天然没药：呈不规则颗粒性团块，大小不等，大者长达6cm以上。表面黄棕色或红棕色，近半透明部分呈棕黑色，被有黄色粉尘。质坚脆，破碎面不整齐，无光泽。有特异香气，味苦而微辛。本品粉末乙醚滤液置蒸发皿中挥尽后，残留的黄色液体滴加硝酸，显褐紫色。本品粉末加香草醛试液数滴，天然没药立即显红色，继而变为红紫色；胶质没药立即显紫红色，继而变为蓝紫色。松花粉（B错）与蒲黄（C错）为花粉粒，属于花类中药。其性状鉴别，2022年考试指南未明确说明。